在代谢过程中具有“饱和代谢动力学”特点的药物是
A. 苯妥英钠
B. 苯巴比妥
C. 艾司唑仑
D. 盐酸阿米替林
E. 氟西汀

正确答案：A。苯妥英钠

解析：本题考查巴比妥类药物。在代谢过程中具有“饱和代谢动力学”特点的药物是苯妥英钠（A对）。苯妥英钠为乙内酰脲的5位两个氢被苯基取代后所得，具有“饱和代谢动力学”的特点，如果用量过大或短时内反复用药，可使代谢酶饱和，代谢将显著减慢，并易产生毒性反应。苯巴比妥（B错）约48%～65%的苯巴比妥在肝脏代谢，转化为羟基苯巴比妥。苯巴比妥为肝药酶诱导剂，提高药酶活性，不但加速自身代谢，还可加速其他药物代谢。大部分与葡萄糖醛酸或硫酸盐结合，由肾脏排出。艾司唑仑（C错）在肝脏主要经CYP3A代谢。经肾排泄，排泄缓慢。盐酸阿米替林（D错）主要在肝脏代谢，活性代谢产物为去甲替林，自肾脏排泄。氟西汀（E错）在肝脏经CYP2D6代谢，生成去甲氟西汀，亦有抗抑郁作用。